钩端螺旋体病哪一型肾衰是最主要的死亡原因
A. 肾衰竭型
B. 黄疸出血型
C. 肺出血型
D. 单纯型
E. 脑膜脑炎型

正确答案：B。黄疸出血型

解析：钩端螺旋体病的黄疸出血型肾衰是最主要的死亡原因（B对）。